属于主动靶向制剂的有
A. 磁性微球
B. 免疫微球
C. 长循环脂质体
D. 修饰的微乳
E. pH敏感靶向制剂

正确答案：B、C、D。免疫微球；长循环脂质体；修饰的微乳

解析：本题考查主动靶向制剂修饰的药物载体。属于主动靶向制剂的有免疫微球（B对）、长循环脂质体（C对）、修饰的微乳（D对）。主动靶向制剂修饰的药物载体主要有：①修饰的脂质体：如长循环脂质体，脂质体经表面修饰后，可避免单核巨噬细胞吞噬，延长在体内循环时间；免疫脂质体，即在脂质体表面接上某种抗体，具有对靶细胞分子水平上的识别能力，可提高脂质体的靶向性；糖基修饰的脂质体，即不同糖基结合在脂质体表面，导致脂质体在体内产生不同的分布。②修饰的微球，采用聚合物将抗原、抗体吸附或交联成微球，称为免疫微球，可用于抗癌药物的靶向治疗、标记和分离细胞作诊断和治疗。③其他，如修饰的微乳、修饰的纳米球等。物理化学靶向制剂：是用物理和化学法使靶向制剂在特定部位发挥药效。这类制剂主要有：①磁性制剂，采用体外磁响应导向至靶部位的制剂，称为磁性靶向制剂。主要包括磁性微球（A错）和磁性纳米囊。磁性微球主要由磁性材料、骨架材料及药物三部分组成。磁性制剂的形态、粒径分布、溶胀能力、吸附性能、体外磁响应、载药稳定性等均影响其靶向性。②栓塞靶向制剂。③热敏靶向制剂。④pH敏感靶向制剂（E错）等。